Graves病患者血清中的促甲状腺素受体的抗体主要是
A. IgG
B. IgA
C. IgE
D. IgM
E. IgD

正确答案：A。IgG